支配骨间肌的神经是
A. 肌皮神经肌支
B. 桡神经深支
C. 尺神经深支
D. 正中神经返支
E. 无

正确答案：C。尺神经深支

解析：肌皮神经肌支（A错）支配喙肱肌、肱二头肌和肱肌。桡神经深支（B错）分布于前臂伸肌群、桡尺远侧关节、腕关节和掌骨间关节。尺神经深支（C对）布于小鱼际肌、拇收肌、骨间掌侧肌、骨间背侧肌及第3、4蚓状肌。正中神经返支（D错）支配除拇收肌以外的鱼际肌群。